女，28岁。婚后5年未孕，月经稀发、肥胖，多毛。妇科检查：子宫未见异常，双侧卵巢稍大。基础体温单相。该患者最可能的诊断是
A. 多囊卵巢综合征
B. 生殖器结核
C. 无排卵性功能失调性子宫出血
D. 卵巢早衰
E. 子宫内膜异位症

正确答案：A。多囊卵巢综合征

解析：该患者为育龄期女性，婚后5年未孕，月经稀发，肥胖，多毛（多囊卵巢综合征多表现为月经稀发、不孕、肥胖和多毛，其中多毛为高雄激素血症最常见表现）。妇科检查：子宫未见异常，双侧卵巢稍大。基础体温单相（为无排卵的表现）。符合多囊卵巢综合征的诊断标准2项，故最可能的诊断是多囊卵巢综合征（A对）。生殖器结核（P266）（B错）会出现不孕、月经失调、结核中毒的症状；无排卵性功能失调性子宫出血（P345）（C错）最常见的症状是子宫不规则出血，表现为月经周期紊乱，经期长短不一，经量不定或增多，甚至大量出血；子宫内膜异位症（E错）（P271）的主要临床表现为继发性痛经、进行性加重、不孕，双合诊检查时，可发现子宫后倾固定，一侧或双侧附件处触及囊实性包块，活动差。以上三项均不会出现多毛等高雄激素的症状。卵巢早衰（P354）（D错）是指40岁前，由于卵巢内卵泡耗竭或医源性损伤发生卵巢功能衰竭，表现为继发性闭经，常伴围绝经期症状，无双侧卵巢增大。